舟车丸的功能是
A. 润肠通便
B. 活血通便
C. 行气逐水
D. 泻火通便
E. 健脾利湿

正确答案：C。行气逐水

解析：本题考查的是舟车丸的功能。舟车丸的功能是行气逐水（C对）。舟车丸：【功能】行气逐水。麻仁胶囊：【功能】润肠通便（A错）。虎杖：【功效】利湿退黄，清热解毒，活血祛瘀，化痰止咳，泻下通便（B错）。当归龙荟丸：【功能】泻火通便（D错）。尿毒清颗粒：【功能】通腑降浊，健脾利湿（E错），活血化瘀。